含有苯并吡喃的双色酮结构，在肺部的吸收为8%，常以气雾剂使用的抗哮喘药物是
A. 孟鲁司特
B. 曲尼司特
C. 色甘酸钠
D. 氨茶碱
E. 齐留通

正确答案：C。色甘酸钠

解析：本题考查影响白三烯的平喘药色甘酸钠。色甘酸钠（C对）含有苯并吡喃环双色酮结构，在肺部的吸收为8%，常以气雾剂使用；孟鲁司特（A错）不含有双色酮结构，为选择性白三烯受体的拮抗剂；曲尼司特（B错）不含苯并吡喃，是一种抗变态反应药物；氨茶碱（D错）茶碱与乙二胺的复盐；齐留通（E错）为平喘药。